（）表示外源化学物的剂量与某一群体中质反映发生率之间的关系
A. 剂量-反应关系
B. 剂量-量反应关系
C. 剂量-质反应关系
D. 剂量-效应关系

正确答案：C。剂量-质反应关系

解析：本题考查剂量-质反应关系。剂量-质反应关系（C对ABD错）表示外源化学物的剂量与某一群体中质反映发生率之间的关系。